黄芩苷的结构中含有
A. 葡萄糖醛酸结构单元
B. 酚羟基结构单元
C. 二氢黄酮结构单元
D. 二氢黄酮醇结构单元
E. 查耳酮结构单元

正确答案：A、B。葡萄糖醛酸结构单元；酚羟基结构单元

解析：本题考查的是黄芩苷的结构。黄芩苷的结构中含有葡萄糖醛酸结构单元（A对）、酚羟基结构单元（B对）。黄芩苷的结构有两个特点，一是黄芩苷是苷元与葡萄糖醛酸形成的苷，这与其他葡萄糖苷等苷类化合物不同，该化合物具有弱酸性，酸性条件下稳定；二是黄芩苷水解后的产物黄芩素A环上有三个相邻的羟基，该化合物在肝脏代谢酶的作用下，三个羟基可以发生葡萄糖醛酸化、硫酸化或甲基化的Ⅱ相代谢途径。